下列除哪项外，均属于虚性闭经的病因病机
A. 肝肾不足
B. 痰湿阻滞
C. 气血虚弱
D. 阴虚血燥
E. 脾虚血少

正确答案：B。痰湿阻滞

解析：闭经病因有虚实之分。虚性闭经多因肝肾不足（A对）、气血虚弱（C对）、阴虚血燥（D对）、脾虚血少（E对）导致精亏血少，冲任不充，血海空虚，无血可下所致。实性闭经多因痰湿阻滞、气滞血瘀、寒凝血瘀导致邪气阻隔，冲任阻滞，脉道不通，经血不得下行所致（B错，为本题正确答案）。